诊断温抗体型溶血性贫血最重要的实验室检查是
A. Ham试验
B. Coombs试验
C. 红细胞渗透性脆性试验
D. 免疫球蛋白测定
E. 血红蛋白电泳

正确答案：B。Coombs试验

解析：温抗体型溶血性贫血是自身免疫性溶血性贫血（AIHA）的一种，AIHA系因免疫调节功能发生异常，产生抗自身红细胞抗体致使红细胞破坏的一种溶血性贫血，Coombs试验（B对）可检测到红细胞表面的自身抗体，是诊断温抗体型溶血性贫血最重要的实验室检查。Ham试验（A错）是诊断阵发性睡眠性血红蛋白尿重要的实验室检查；红细胞渗透性脆性试验（P553）（C错）是诊断遗传性球形细胞增多症重要的实验室检查；免疫球蛋白测定（九版诊断学P409）（D错）主要用于感染性疾病、免疫增生性疾病和免疫缺陷性疾病的鉴别诊断；血红蛋白电泳（P556）（E错）是诊断珠蛋白生成障碍性贫血重要的实验室检查。